对于瘢痕性幽门梗阻胃中积热证者，宜用
A. 导痰汤加减
B. 丁香透脓散加减
C. 大黄黄连泻心汤加减
D. 麦门冬汤加减
E. 化肝煎加减

正确答案：C。大黄黄连泻心汤加减

解析：大黄黄连泻心汤清热消痞，治疗瘢痕性幽门梗阻胃中积热证（C对）。导痰汤，功效主治：燥湿化痰，理气和中。治疗痰涎壅盛之胸膈痞塞，或咳嗽恶心，饮食少思；或肝风挟痰之呕不能食，头痛眩晕，甚或一切痰厥，头目眩晕（A错）。丁香透脓散具有托毒溃脓之功效。主治痈疽诸毒，内脓已成不穿破者（B错）。麦门冬汤具有清养肺胃，降逆下气之功效。主治虚热肺痿，治疗瘢痕性幽门梗阻气阴两虚证（D错）。化肝煎善解肝气之郁，平气逆而散郁火。主要治疗怒气伤肝，气逆动火，胁痛胀满，烦热动血（E错）。